关于第二心音分裂的描述错误的是
A. 生理性分裂在青少年中更多见
B. 肺动脉高压时可出现通常分裂
C. 固定分裂可见于房间隔缺损
D. 反常分裂可见于完全性右束支传导阻滞
E. 逆分裂可见于主动脉瓣狭窄

正确答案：D。反常分裂可见于完全性右束支传导阻滞

解析：第二心音的分裂分为生理性分裂、通常分裂、固定分裂和反常分裂。生理性分裂是由于深吸气时胸腔负压增加，右心回心血量增多，右心室排血时间延长，使肺动脉瓣关闭延缓而导致，无心脏疾病存在，在青少年中更多见（A对）。通常分裂是第二心音分裂最常见的类型，见于某些使右心室排血时间延长的情况，如二尖瓣狭窄伴肺动脉高压（B对）、肺动脉瓣狭窄等，也可见于左心室射血时间缩短的情况，如二尖瓣关闭不全，室间隔缺损等。固定分裂是指第二心音的分裂不受吸气或呼气的影响，心音两个成分间的时距相对固定，常见于房间隔缺损（C对）。反常分裂（逆分裂）是由于完全性左束支传导阻滞（D错，为本题正确答案）、主动脉瓣狭窄（E对）、重度高血压等病理情况下，主动脉瓣关闭明显迟于肺动脉瓣的关闭，导致第二心音肺动脉部分在前、主动脉部分在后。